可引起毒性休克综合征的细菌是
A. 肺炎链球菌
B. 脑膜炎奈瑟菌
C. 铜绿假单胞菌
D. 甲型溶血性链球菌
E. 金黄色葡萄球菌

正确答案：E。金黄色葡萄球菌

解析：可引起毒性休克综合征的细菌是毒性休克综合征毒素-1（TSST-1），是金黄色葡萄球菌（E对）分泌一种外毒素，毒性休克综合征毒素-1能增加机体对内毒素的敏感性，感染产毒菌株后，可引起机体多个器官系统的功能紊乱或毒性休克综合征，表现为发热、休克及脱屑性皮疹等。肺炎链球菌（A错）主要引起大叶肺炎、脑膜炎、支气管炎等（P99）。脑膜炎奈瑟菌（B错）主要引起化脓性脑膜炎，即流行性脑脊髓膜炎（P105）。铜绿假单胞菌（C错）感染常见于皮肤黏膜受损部位，如烧伤、创伤或手术切口等，表现为局部化脓性炎症，也可引起中耳炎、角膜炎、尿道炎、胃肠炎、心内膜炎和脓胸等（P170）。甲型溶血性链球菌（草绿色链球菌）（D错）属链球菌属，易引发龋齿和心内膜炎，是感染性心内膜炎最常见的致病菌（P102）。